神经细胞动作电位的主要组成是
A. 峰电位
B. 阈电位
C. 负后电位
D. 局部电位
E. 正后电位

正确答案：A。峰电位